能在细菌遗传物质间自行移动的是
A. 染色体
B. 质粒
C. 毒力岛
D. 转座因子
E. 前噬菌体

正确答案：D。转座因子

解析：转座因子（又称转位因子）为细菌基因组中可以百变自身位置的独特DNA片段，它可在染色体、质粒及噬菌体之间转移，又分为插入序列（IS）和转座子（Tn）。掌握“细菌遗传变异的物质基础及机制”知识点。